有包膜并以出芽方式释放的病毒对宿主感染方式属于
A. 杀细胞性感染
B. 促细胞凋亡
C. 基因组合整合感染
D. 细胞增生与转化
E. 稳定状态感染

正确答案：E。稳定状态感染

解析：稳定状态感染：多见于有包膜并以出芽方式释放的病毒，如副黏病毒属病毒等感染，或有包膜病毒以高尔基体转运并释放的病毒，如丙型肝炎病毒（HCV）感染等。掌握“病毒传播方式、感染类型、致病机制及免疫”知识点。